女，45岁，突发有下腹痛伴呕吐，停止排气排便7小时，查体：P110次/分，BP130/80mmHg，右侧腹股沟韧带下方卵圆窝处可触及半球形包块，压痛明显，不能还纳。正确的处理是
A. 立即扩容补液
B. 手法还纳包块
C. 应用吗啡，缓解疼痛
D. 密切观察病情变化
E. 立即手术治疗

正确答案：E。立即手术治疗

解析：中年女性（股疝的好发人群）患者，突发有下腹痛伴呕吐，停止排气排便7小时，右侧腹股沟韧带下方卵圆窝处可及半球形包块（股疝的典型表现），结合患者病史和临床表现，应诊断为右侧股疝。该患者疝块压痛明显、不能还纳，且有呕吐、停止排便排气等肠梗阻表现，提示股疝已嵌顿，因此正确的处理是立即手术治疗（E对），防止嵌顿疝发展为绞窄性疝。该患者血压正常，无休克表现，因此，不需要立即扩容补液（A错）。患者包块不能还纳，不宜强行手法复位，以免损伤肠管，加重病情（B错）。腹股沟疝、股疝的患者禁忌应用吗啡等镇痛药物，以免掩盖病情，错过最佳手术治疗时机（C错）。股疝容易发生嵌顿，不论是否发生绞窄都应及时手术治疗，而不应采取密切观察病情变化等保守治疗方法（D错）。